下列不属于弥漫性结缔组织病的是
A. 系统性红斑狼疮
B. 类风湿关节炎
C. 硬皮病
D. Reiter综合征
E. 干燥综合征

正确答案：D。Reiter综合征

解析：弥漫性结缔组织病是以疏松结缔组织黏液样水肿及纤维蛋白样变性为病理基础的一组疾病，包括系统性红斑狼疮（A对）、硬皮病（C对）、皮肌炎、类风湿关节炎（B对）、结节性多动脉炎、韦格纳氏肉芽肿、巨细胞动脉炎及干燥综合征（E对）等。Reiter综合征（D错，为本题正确答案）即反应性关节炎，临床上以结膜炎、尿道炎和关节炎为特征，属于脊柱关节病。